补体膜攻击复合物是
A. C3b
B. C5b
C. C5b6789
D. C5b678
E. C5b67

正确答案：C。C5b6789